下列治疗心力衰竭的药物中，不能延缓心肌重构的是
A. 依那普利
B. 呋塞米
C. 坎地沙坦
D. 美托洛尔
E. 螺内酯

正确答案：B。呋塞米

解析：本题考查延缓心肌重构的药物。不能延缓心肌重构的是呋塞米（B错，为本题正确答案）。呋塞米是利尿剂，不能抑制心肌重构。依那普利（A对）是ACEI类，坎地沙坦（C对）是ARB类，螺内酯（E对）为醛固酮受体阻断剂，美托洛尔（D对）是β受体阻断剂，均可以抑制心肌重构。